患者，女，46岁。风湿性心脏病史8年，二尖瓣狭窄，心功能Ⅰ级。口内有右下侧切牙、右下第一磨牙、左下侧切牙及左下第一磨牙残根，Ⅱ~Ⅲ度松动，需要拔除。引起以上严重并发症的最重要因素之一，是以下哪种细菌菌血症
A. 金黄色葡萄球菌
B. 铜绿假单胞菌
C. 混合细菌
D. 变形链球菌
E. 绿色链球菌

正确答案：E。绿色链球菌

解析：引起细菌性心内膜炎的重要因素之一是绿色链球菌菌血症。掌握“牙拔除的适应证与禁忌证”知识点。